正常情况下胃黏膜不会被胃液所消化的主要原因是
A. 胃液中不含有可消化胃黏膜的酶
B. 黏液-碳酸氢盐屏障的作用
C. 胃液中的内因子对胃黏膜具有保护作用
D. 胃液中的糖蛋白可中和胃酸
E. 胃液中含有大量HCO₃⁻可中和胃酸

正确答案：B。黏液-碳酸氢盐屏障的作用